《素问·上古天真论》说明顺应自然的养生原则是
A. 服从天气
B. 去世离俗
C. 春夏养阳
D. 秋冬养阴
E. 法于阴阳

正确答案：E。法于阴阳

解析：《素问·上古天真论》说明养生的具体方法：一法于阴阳（E对），即效法自然阴阳变化规律，调养身心，养正以避邪。二和于术数，即施行合宜的养生术，顺四时调形体，如导引、按跷、吐纳、咽津等调神健身的方法。三食饮有节，包括节饮食、忌偏嗜、适寒温等几个方面。四起居有常，生活作息、工作要有规律。五不妄作劳，劳作不违背常度。